抗原性及变态反应风险最高的溶栓药物是
A. 重组链激酶
B. 尿激酶
C. 瑞替普酶
D. 替奈普酶
E. 阿替普酶

正确答案：A。重组链激酶

解析：本题考查溶栓药。抗原性及变态反应风险最高的溶栓药物是重组链激酶（A对）。重组链激酶血浆半衰期为5～30min，是抗原性及变态反应风险最高的溶栓药物。尿激酶（B错）是从新鲜人尿中提取的一种能激活纤溶酶原的激活剂。瑞替普酶（C错）全称是重组人组织型纤溶酶原激酶衍生物，是t-PA的单链非糖基化缺失变异体。替奈普酶（D错）是t-PA经过基因修饰后的多点变异体。阿替普酶（E错）具有纤维蛋白特异性，能在循环中表现出相对的非活性状态。